下列不属于工作负荷评价指标的是
A. 血常规
B. 心率
C. 肌电图
D. 心率变异性
E. 脑诱发电位

正确答案：A。血常规